患者大便时溏时泻，水谷不化，稍进油腻之物，则大便次数增多，食少，脘腹胀闷，面黄，肢倦乏力，舌淡苔白，脉细弱。其治法是
A. 健脾益气
B. 益胃升阳
C. 健脾益胃
D. 健脾温中
E. 温补脾胃

正确答案：A。健脾益气

解析：题中患者以大便时溏时泻，迁延反复，稍进油腻食物，则大便次数明显增加为主症，故诊断为泄泻。大便时溏时泻为脾胃虚弱，运化无权，水谷不化，清浊不分所致；脾气虚弱，运化失常，故食少，脘腹胀闷，稍进油腻食物，则大便次数明显增加；久泻不止，脾胃虚弱，气血生化不足，故面黄，肢倦乏力；舌淡苔白，脉细弱为脾胃虚弱之象，故辨为脾胃虚弱证，治宜健脾益气，化湿止泻（A对）。题中患者无阳虚气陷的症状（B错）。泄泻脾胃虚弱是因脾虚失运，清浊不分所致，故健脾益气为主，益胃次之（C错）。健脾温中为脾阳虚弱的治法（D错）。温补脾胃为脾胃虚寒的治法（E错）。